使用化妆品后24小时出现面部水肿，渗出，痒痛，应属于
A. Ⅰ型超敏反应
B. Ⅱ型超敏反应
C. Ⅲ型超敏反应
D. Ⅳ型超敏反应
E. 以上都不是

正确答案：D。Ⅳ型超敏反应